荸荠，海蜇，枇杷，薏苡仁，适合下列哪类体质人群食用
A. 阴虚
B. 淤血
C. 气虚
D. 痰湿
E. 血虚

正确答案：D。痰湿

解析：荸荠能化痰利咽、通利小便，海蜇能益气化痰，枇杷能润肺化痰，薏苡仁能健脾止泻、利水渗湿，所以适合痰湿体质人群食用（D对）。阴虚体质的人，适合多食清补类食物如小米、绿豆、荞麦、百合、藕、枸杞等以及宜食甘凉滋润、生津养阴的水果如梨，甘蔗，苹果等（A错）。对于血瘀体质的人，可以多吃益气养血、活血化瘀、温散的食物，如萝卜、大蒜、生姜、山楂、韭菜、洋葱、蘑菇、辣椒等食物（B错）。气虚的体质可以多吃吃些补气的食物如：羊肉、牛肉、鸡肉、糯米、大豆、白扁豆、大枣、鲫鱼等（C错）。血虚体质的人可以适量吃补血食物，如龙眼肉、荔枝、红糖、胡萝卜、桑葚、羊肝、鸡肉、鸡肝等（E错）。